感染性心内膜炎有诊断意义的依据是
A. 血培养
B. 血沉
C. 血象
D. 尿常规
E. 血清免疫学检查

正确答案：A。血培养

解析：感染性心内膜炎的临床表现缺乏特异性，超声心动图和血培养是诊断感染性心内膜炎的两大基石。掌握“自体瓣膜感染性心内膜炎”知识点。